医疗伦理学属于
A. 描述伦理学
B. 境遇伦理学
C. 规范伦理学
D. 元伦理学
E. 生态伦理学

正确答案：C。规范伦理学

解析：医学伦理学属于应用-规范伦理学（C对）范畴，主要或最终回答医务人员应该做什么、不应该做什么，怎样做善事而不做恶事。伦理学的三种基本类型为：规范伦理学、元伦理学和描述伦理学（BE错）。描述伦理学（A错）（记述伦理学）是指对道德现象的研究，既不涉及行为的善恶及其标准，也不谋求制定行为准则或规范，只是依据其特有的学科立场和方法对道德现象进行经验性描述和再现的伦理学。元伦理学（D错）（分析伦理学）是指研究伦理学本身，即对伦理学的性质、道德概念、道德逻辑分析和道德判断等进行研究，而不指定道德规范和价值标准，并且对任何道德规范、价值标准都采取中立立场的伦理学。